关于颗粒剂粒度要求的叙述，正确的是
A. 不能通过一号筛和能通过四号筛的颗粒和粉末总和，不得超过15%
B. 不能通过一号筛和能通过四号筛的颗粒和粉末总和，不得超过10%
C. 不能通过一号筛和能通过五号筛的颗粒和粉末总和，不得超过15%
D. 不能通过一号筛和能通过六号筛的颗粒和粉末总和，不得超过10%
E. 不能通过一号筛与能通过五号筛的总和不得过10%

正确答案：C。不能通过一号筛和能通过五号筛的颗粒和粉末总和，不得超过15%

解析：本题考查颗粒剂的质量要求。关于颗粒剂粒度要求的叙述，正确的是不能通过一号筛和能通过五号筛的颗粒和粉末总和，不得超过15%（C对）。颗粒剂粒度：不能通过一号筛与能通过五号筛的总和不得过15%。